与湿浊内生关系最密切的是
A. 肾的气化功能减退
B. 膀胱失司
C. 脾失健运
D. 肺失宣降
E. 三焦气化失司

正确答案：C。脾失健运

解析：内湿的形成，多因过食肥甘，恣食生，内伤脾胃，致使脾失健运不能为胃行其津液，或素体肥胖，喜静少动，致气机不利，津液输布障碍，聚而成湿所致。因此，脾的运化失职是湿浊内生的关键（C对）；肾、膀胱、肺、三焦的功能均与机体的水液代谢、输布和排泄相关，但和湿浊内生关系并不密切（ABDE错）。